易发生延迟愈合的是
A. 肱骨髁上骨折
B. 股骨颈骨折
C. 股骨干骨折
D. 腓骨上段骨折
E. 胫骨下1/3骨折

正确答案：E。胫骨下1/3骨折

解析：易发生延迟愈合的是胫骨下1/3骨折（E对），骨折损伤营养动脉，且几乎无肌肉附着，使血液循环减少。肱骨髁上骨折（A错）可损伤肱动脉，加上损伤后的组织反应，局部肿胀严重，均会影响远端肢体血液循环，导致前臂骨筋膜室综合征，处理不当导致缺血性肌挛缩，但不引起延迟愈合。股骨颈骨折（B错），尤其是头下型骨折，易发生缺血坏死，而非延迟愈合。股骨干骨折（C错）、腓骨上段骨折（D错）时，由于周围有较丰富的肌肉和血管提供血供，因此较为容易愈合。